关于脊髓的内部结构
A. 颈段灰质有前角,侧角和后角
B. 胸段的灰质仅有前角和后角
C. 上腰段的灰质有前角、侧角和后角
D. 中央管向下与蛛网膜下腔相通
E. 以上都不对

正确答案：C。上腰段的灰质有前角、侧角和后角

解析：颈段灰质只有前角和侧角（A错），从T1-L3才有侧角（B错C对）。第四脑室与蛛网膜下隙相通（D错）。